某男，84岁。久病，近患感冒，因发汗过多，出现精神疲惫，肌肤手足逆冷，冷汗淋漓，脉微欲绝。分析该病机是
A. 阳盛
B. 阳虚
C. 亡阳
D. 阴盛
E. 阴虚

正确答案：C。亡阳

解析：本题考查的是阴阳失调病机。久病，近患感冒，因发汗过多，出现精神疲惫，肌肤手足逆冷，冷汗淋漓，脉微欲绝。分析该病机是亡阳（C对）。亡阳：亡阳，是指机体的阳气发生突然性脱失，而致全身功能突然严重衰竭的病机变化。临床表现可见冷汗淋漓、肌肤手足逆冷、精神疲惫、神情淡漠，甚则见昏迷、脉微欲绝等症状。阳盛（A错）：又称“阳偏盛”，是指机体在疾病过程中，出现的阳邪偏盛、功能亢奋、热量过剩的病机变化。由于阳是以热、动、燥为其特点，阳偏胜，即出现热象，所以说“阳胜则热”。如壮热、面红、目赤等，即是阳偏盛的具体表现。阳虚（B错）：又称“阳偏衰”，是指机体阳气虚损、功能减退或衰弱、热量不足的病机变化。阳虚则寒，不但可见到面色白、畏寒肢冷、舌淡、脉迟等寒象，而且还有喜静踡卧、小便清长、下利清谷等虚象。阴盛（D错）：又称“阴偏盛”，是指机体在疾病过程中所出现的一种阴邪偏盛、功能障碍或减退、产热不足，以及病变性代谢产物积聚的病机变化。阴是以寒、静、湿为其特点，阴偏盛，就出现寒象，所以说“阴胜则寒”。如形寒、肢冷、舌淡等，即是阴偏胜的具体表现。阴虚（E错）：又称“阴偏衰”，是指机体精、血、津液等物质亏耗，以及阴不制阳，导致阳相对亢盛、功能虚性亢奋的病机变化。五心烦热、骨蒸潮热、颧红消瘦、盗汗、咽干口燥、舌红少苔、脉细数无力等，即是阴虚则热的表现。